视觉反射中枢位于
A. 缘上回
B. 角回
C. 上丘
D. 下丘
E. 颞横回

正确答案：C。上丘

解析：视觉反射中枢位于端脑距状沟上下的视区皮质（纹区），即上丘（C对）。